患者常常自汗出，畏风，易于感冒，面色淡白，神疲体倦，舌淡苔白，脉细，其证型是
A. 外感风邪
B. 外感寒邪
C. 外感热邪
D. 肺气虚
E. 脾肺气虚

正确答案：D。肺气虚

解析：患者自汗，是由于肺气亏虚，宣发卫气无力，气不摄津；畏风，易于感冒，是由于气虚不能固表；神疲体倦，面色淡白，舌淡苔白脉弱，均为气虚之象（D对ABCE错）。